下列各项，用于艾滋病诊断和评价抗病毒疗效的实验室指标是
A. ELISA法检査p24抗体和gp120抗体
B. ELISA法测定p24抗原
C. SRIP法检查p24抗体和gp120抗体
D. RT-PCR法检测HIVRNA
E. WB法检查p24抗体和gp120抗体

正确答案：A。ELISA法检査p24抗体和gp120抗体

解析：ELISA是最常用的初筛HIV感染的方法，灵敏性和特异性较强，检测血清、尿液、唾液或脑脊液抗HIV可获阳性结果，主要为血清p24和gp41抗体阳性（A对）。病毒表面的包膜糖蛋白gp120为其天然配体，gp160是HIV-1包膜上唯一的糖蛋白，蛋白酶水解将其分成非共价连接的两部分：表面糖蛋白gp120和跨膜糖蛋白gp41。当病毒表面的gp120与细胞表面的CD4T细胞分子发生高亲和力结合后，病毒蛋白gp41发生构象变化，暴露出gp41末端的融合肽，融合肽插入CD4T细胞膜，破坏了膜结构的稳定。Gp41变化为最后的融合性构象，使病毒包膜和靶细胞质膜相互靠近，继而发生融合，病毒进入靶细胞。